影响神经系统发育最重要的激素
A. 生长素
B. 甲状腺激素
C. 糖皮质激素
D. 胰岛素
E. 性激素

正确答案：B。甲状腺激素